可用ph梯度萃取法分离的化合物类型是
A. 萜类
B. 多聚糖类
C. 单糖类
D. 单聚糖类
E. 生物碱类

正确答案：E。生物碱类

解析：本题考查生物碱的分离方法。可用pH梯度萃取法分离的化合物类型是生物碱类（E对）。基于生物碱碱性差异的分离方法：总生物碱中各单体生物碱的碱性往往不同，可用pH梯度萃取法进行分离。萜类（A错）化合物的分离方法：（1）利用特殊官能团分离（2）结晶法分离（3）柱色谱法分离。单糖（C错）及低聚糖（D错）的分离方法：如提取物中单糖或二糖含量很高，可用结晶方法分出。多糖化合物（B错）的分离方法：采用上述提取方法获得的多糖提取液，都含有许多杂质，主要是无机盐、单糖、寡糖、小分子极性物质、大分子水溶性杂质（如蛋白质、木质素）及一些色素，需要对其进行纯化。